右心室窦部和漏斗部的分界是
A. 界嵴
B. 三尖瓣前瓣
C. 三尖瓣隔侧瓣
D. 三尖瓣后瓣
E. 室上嵴

正确答案：E。室上嵴

解析：右心室窦部又称固有心腔（窦部），右心室流出道又称动脉圆锥或漏斗部，室上嵴（E对）为两者的分界。